治疗窦性心动过速宜选用的药物是
A. 普萘洛尔
B. 溴苄铵
C. 恩卡尼
D. 利多卡因
E. 苯妥英钠

正确答案：A。普萘洛尔

解析：本题考查普萘洛尔。治疗窦性心动过速宜选用的药物是普萘洛尔（A对）。普萘洛尔临床上主要用于室上性心律失常。对于交感神经兴奋性过高、甲状腺功能亢进及嗜铬细胞瘤等引起的窦性心动过速效果良好。溴苄胺（B错）仅用于一线抗心律失常药如利多卡因或普鲁卡因胺治疗无效而又威胁生命的室性心律失常，特别是室颤。恩卡尼（C错）适用于室性早搏、室性心动过速及心室颤动也可用于室上性心动过速。利多卡因（D错）临床上主要用于各种室性心律失常的治疗，如急性心肌梗死或强心苷中毒所致室性心动过速或室颤，是治疗室性心律失常的首选药物。苯妥英钠（E错）为乙内酰脲类抗癫痫药，现已成为治疗强心苷中毒所致快速型心律失常的首选药物。